2007年中国居民膳食指南指出，每人每日食盐摄入量不超过
A. 5g
B. 6g
C. 7g
D. 8g
E. 10g

正确答案：B。6g